关于细胞凋亡，下列叙述中哪项是不正确的
A. 凋亡见于许多生理和病理过程
B. 发生单个细胞死亡或小灶性细胞死亡
C. 凋亡不引起炎症反应
D. 可见凋亡小体
E. 凋亡是由酶解作用所致

正确答案：E。凋亡是由酶解作用所致

解析：细胞凋亡是指活体内局部组织中单个细胞或小灶性细胞程序性死亡（B对），可见于许多生理和（轻微）病理过程（A对）。细胞凋亡不引起周围组织炎症反应（C对），其形态学特征是凋亡小体（D对）的形成。由酶解作用所致（E错，为本题正确答案）的是细胞坏死。